颅骨病变的影像学表现多为穿凿样骨质缺损的是以上哪种疾病
A. 嗜酸性肉芽肿
B. 汉-许-克病
C. 骨纤维异常增殖症
D. 局限性侵袭性牙周炎
E. 糖尿病性牙周炎

正确答案：A。嗜酸性肉芽肿

解析：本题考查嗜酸性肉芽肿。颅骨病变的影像学表现多为穿凿样骨质缺损的是嗜酸性肉芽肿（A对）。嗜酸性肉芽肿又称局限性组织细胞增生症。颅骨最常累及，其次为颌骨、肋骨、脊柱等。颅骨病变的影像学表现多为穿凿样骨质缺损。